主含蒽醌类成分的药材是
A. 苏木
B. 钩藤
C. 木通
D. 大血藤
E. 鸡血藤

正确答案：D。大血藤

解析：本题考查的是大血藤的有效成分。主含蒽醌类成分的药材是大血藤（D对）。大血藤的成分有鞣质，大黄素，大黄素甲醚，胡萝卜苷，毛柳苷，大血藤醇等。蒽醌类成分包括大黄素，大黄素甲醚。苏木（A错）的成分有心材含巴西苏木素，苏木酚，挥发油，鞣质等。钩藤（B错）所含有效成分为钩藤碱、异钩藤碱等生物碱，加热易被破坏，故一般宜生用，入汤剂亦不可久煎，宜后下。木通（C错）的成分有齐墩果酸，常春藤皂苷元，木通苯乙醇苷B，白桦脂醇等。鸡血藤（E错）的成分有鞣质，多种异黄酮、二氢黄酮、查耳酮、拟雌内酯类、三萜类和甾醇类成分等。